与氢氯噻嗪相比，呋塞米的特点是
A. 效能高、效价低
B. 效能低、效价高
C. 效能效价都高
D. 效能效价均低
E. 效能效价相等

正确答案：A。效能高、效价低

解析：本题考查呋塞米的特点。与氢氯噻嗪相比，呋塞米的特点是效能高、效价低（A对）。最大效应：指在一定范围内，增加药物剂量或浓度，所能达到的最大效应，继续增加剂量或浓度，效应不能再上升，此效应为一极限，也称效能，在图中呋塞米的最大效应大于氢氯噻嗪；效价强度：指用于作用性质相同的药物之间的等效剂量或浓度的比较，达到同样效应，氢氯噻嗪所用剂量小于呋塞米，故氢氯噻嗪的效价高。